下列哪一个疾病不是肾上腺素受体阻断药的适应证
A. 心绞痛
B. 甲状腺功能亢进
C. 窦性心动过速
D. 高血压
E. 支气管哮喘

正确答案：E。支气管哮喘

解析：肾上腺素激动药异丙肾上腺素、沙丁胺醇等可激动β₂受体，有强大的舒张支气管平滑肌作用，支气管平滑肌处于痉挛状态时，效果尤为显著，也可抑制组胺等过敏介质的释放，可用于控制支气管哮喘的急性发作（E错，为本题正确答案）。β肾上腺素受体阻断剂阻断心脏β₁受体，使心率减慢、心肌收缩力减弱，心输出量减少，心肌耗氧量下降，对心绞痛有良好的疗效（A对）。肾上腺素受体阻断药可用于甲状腺机能亢进的辅助治疗（B对）。β肾上腺素受体阻断剂如普萘洛尔等具有中等程度的降压作用，单独应用适用于轻、中度高血压（D对），尤其对高血压伴有心输出量偏高或血浆肾素水平偏高的患者疗效较好，与利尿药合用降压作用增强，对伴有心动过速、心绞痛、心律失常、脑血管病变的高血压病人也有显著效果；具有抑制交感神经的作用，可用于室上性心律失常，如心房颤动、心房扑动以及阵发性室上性心动过速等，尤其对于交感神经兴奋性过高、甲状腺功能亢进及嗜铬细胞瘤等引起的窦性心动过速效果更好（C对）。